在细胞内作用强于细胞外
A. 对氨基水杨酸
B. 乙胺丁醇
C. 吡嗪酰胺
D. 利福平
E. 卡那霉素

正确答案：C。吡嗪酰胺

解析：本题考查吡嗪酰胺。在细胞内作用强于细胞外的是吡嗪酰胺（C对）。吡嗪酰胺在酸性环境中抗结核分枝杆菌作用较强，主要杀灭巨噬细胞和单核细胞内的缓慢繁殖菌群。对氨基水杨酸钠（A错）仅对细胞外的结核分枝杆菌有抑制作用。乙胺丁醇（B错）对细胞内外的繁殖期结核分枝杆菌有较强的选择性抑制作用，对其他病原体几乎无作用。分枝杆菌均具有强大抗菌作用。利福平（D错）穿透性强，能进入吞噬细胞和结核病灶内，杀灭各种结核病灶中和细胞内外的结核分枝杆菌，尤其对快速繁殖菌群和间断缓慢繁殖菌群具有杀菌作用。